不得进行下腹部放射影像检查，是针对对受孕后
A. 5～10周的育龄妇女
B. 6～12周的育龄妇女
C. 7～14周的育龄妇女
D. 8～15周的育龄妇女
E. 9～18周的育龄妇女

正确答案：D。8～15周的育龄妇女

解析：对育龄妇女腹部或骨盆进行核素显像检查或X射线检查前，应问明是否怀孕；非特殊需要，对受孕后8～15周的育龄妇女，不得进行下腹部放射影像检查。掌握“放射诊疗的防护与法律责任”知识点。